老年男性，因咳嗽，咳黄痰3天就诊。查体发现主动脉瓣区粗糙的收缩期杂音。超声心动图示主动脉瓣狭窄，左室射血分数0.55，心电图检查正常。请问对该患者哪一项处置方法不恰当
A. 抗菌素
B. 化痰药物
C. 血管紧张素转换酶抑制剂
D. 定期做超声心动图
E. 胸部X线检查

正确答案：C。血管紧张素转换酶抑制剂

解析：主动脉瓣狭窄时，左心室射血减少，引起血压下降，机体为了保持重要脏器的血流灌注，通过激活神经内分泌，让外周血管收缩，来维持灌注压。血管紧素转换酶抑制剂（C错，为本题正确答案）可造成左室舒张末压过度下降，导致心排出量减少，引起直立性低血压，因此血管紧素转换酶抑制剂（ACEI）不适合用于主动脉瓣狭窄患者。患者存在咳嗽，咳黄痰等明显肺部感染表现，可使用抗菌素（A对）和化痰药物（B对）对症治疗。轻度狭窄者每2年复查一次，中重度狭窄患者每6～12个月复查一次，复查主要是做超声心动图（D对）。胸部X线检查（E对）可观察患者心影大小，在侧位透视下，可见主动脉瓣膜钙化，有助于评估主动脉瓣狭窄患者的严重程度。